理想的牙周手术后组织愈合的方式是
A. 新附着
B. 再附着
C. 长上皮结合
D. 一般性修复
E. 骨性愈合

正确答案：A。新附着

解析：本题考查牙周手术后组织愈合的方式。牙周手术后组织愈合，理想的方式是新附着（A对），这种愈合方式，是使牙周膜细胞能够优先向冠方生长，占据根面，其中的前体细胞能分化出成牙骨质细胞、成骨细胞和成纤维细胞，在根面沉积新的牙骨质，形成新的牙周膜纤维埋入其中，胶原纤维的另一端埋入新形成的牙槽骨中，形成再生性愈合。再附着（B错）是因手术或创伤等使正常的牙周附着结构被急性破坏后，原来的胶原纤维与正常的牙骨质、牙槽骨正常附着的过程，是发生在原来正常根面上的附着过程。长结合上皮（C错）是指袋深度变浅或消失，在袋内壁与原来暴露于牙周袋内的牙根表面之间有一层长而薄的结合上皮，这种愈合是翻瓣术后最常见的愈合方式。一般性修复（D错）是指牙周手术后炎症消退，组织愈合。骨性愈合（E错）是指当骨髓细胞接触根面是，发生骨固连。